有关皮瓣的叙述中，哪项是错误的
A. 皮瓣感觉的恢复首先为温度觉，最后是痛觉
B. 术后72h内是游离皮瓣最容易发生血管危象的时候
C. 皮瓣设计应比缺损处稍大，以预防皮瓣转移后发生收缩
D. 原则上组织畸形和缺损能用带蒂皮瓣修复就不用游离皮瓣
E. 轴型皮瓣只要在血管的长轴内设计，一般可不受长宽比例的限制

正确答案：A。皮瓣感觉的恢复首先为温度觉，最后是痛觉

解析：无论哪种皮瓣移植后，皮肤的感觉在短期内都是缺失的。感觉的恢复首先为痛觉，最后是温度觉。行游离皮瓣时同时行感觉神经吻合者，可能恢复的时间更快些。在此感觉未恢复的阶段内要注意防止创伤，特别要防止烫伤与冻伤。掌握“皮瓣移植”知识点。